可用于治疗铜绿假单胞菌感染的药物是
A. 头孢呋辛
B. 头孢他啶
C. 头孢米诺
D. 头孢唑林
E. 头孢曲松

正确答案：B。头孢他啶

解析：本题考查药物的作用。头孢曲松（E错）为第三代头孢菌素，对革兰阳性菌虽有一定的抗菌活性，但较第一、二代弱，对肠杆菌科细菌有良好的抗菌作用，其中头孢他啶（B对）对铜绿假单胞菌及某些非发酵菌亦有较好作用。头孢唑林（D错）为第一代头孢菌素，主要作用于需氧革兰阳性球菌。头孢呋辛（A错）为第二代头孢菌素，对革兰阳性球菌的活性与第一代头孢菌素相仿或略差，对部分肠杆菌科细菌具有抗菌活性。头孢米诺（C错）为头霉素类，抗菌谱和抗菌活性与第二代头孢菌素类相似，对大多数超广谱β-内酰胺酶稳定且抗厌氧菌作用强，可用于治疗厌氧菌及产ESBL的革兰阴性杆菌感染。